筛检试验的目的是
A. 对可疑患者进行确诊
B. 为了评价筛检试验的特异度
C. 为了评价筛检试验的灵敏度
D. 防止筛检人群出现漏诊
E. 从表面健康的人群中查出某病的可疑患者或某病的高危人群

正确答案：E。从表面健康的人群中查出某病的可疑患者或某病的高危人群